我国口腔癌发病率的高峰在
A. 25～35岁
B. 25～40岁
C. 35～55岁
D. 40～60岁
E. 50～60岁

正确答案：D。40～60岁

解析：我国口腔癌发病率的高峰为40～60岁。而西方国家的发病高峰在60岁以上，但近年来，不管是我国还是西方国家，患病年龄都有偏高的趋势，主要原因可能与人群的平均寿命延长有关。口腔癌的发病率随年龄的增长而升高。掌握“口腔癌的预防”知识点。